所产生毒素与噬菌体有关的细菌
A. 大肠埃希菌
B. 军团菌
C. 铜绿假单胞菌
D. 流感嗜血杆菌
E. 白喉棒状杆菌

正确答案：E。白喉棒状杆菌

解析：白喉棒状杆菌（E对）产生毒素与噬菌体有关，其机制为溶原性转换，当β棒状杆菌噬菌体侵袭无毒白喉棒状杆菌时，其编码外毒素的tox基因与宿主菌染色体整合，无毒白喉棒状杆菌则成为产毒的白喉棒状杆菌，成为溶源性细菌，并产生白喉毒素，且产毒性状能够随着细胞分裂遗传下去。另外，肉毒梭菌产生的肉毒毒素、金黄色葡萄球菌产生的溶素，以及沙门菌、志贺菌等抗原结构和血清型别均与溶原性转换有关。